根据不同年龄学生的有意注意时间，目前我国普遍采用的每节课时间是
A. 小学20分钟，中学30分钟，大学40分钟
B. 小学30分钟，中学35分钟，大学40分钟
C. 小学40分钟，中学45分钟，大学50分钟
D. 小学45分钟，中学50分钟，大学60分钟
E. 小学45分钟，中学50分钟，大学90分钟

正确答案：C。小学40分钟，中学45分钟，大学50分钟